下列生物碱中碱性最强的是
A. 莨菪碱
B. 樟柳碱
C. 山莨菪碱
D. 东莨菪碱
E. 氧化苦参碱

正确答案：A。莨菪碱